实证感冒的治疗原则是
A. 辛温发汗
B. 辛凉清解
C. 清暑解表
D. 解表达邪
E. 调和营卫

正确答案：D。解表达邪

解析：实证感冒，即包括风寒、风热、暑湿等感受实邪所引发的感冒，其治疗当以解表达邪为基本大法，可以概括对各种实证感冒的治疗方法。故解表达邪为实证感冒的治疗原则（D对）。辛温发汗法治疗感冒之风寒束表证（A错）。辛凉清解法治疗感冒之风热证（B错）。清暑解表法治疗感冒之暑湿伤表证（C错）。调和营卫法治疗外感风寒表虚证（E错）。